某地区在一周内进行了高血压普查，可计算当地高血压的
A. 罹患率
B. 发病率
C. 患病率
D. 病死率
E. 续发率

正确答案：C。患病率

解析：本题考查普查的指标。普查属于现况调查，现况调查所得到的频率指标一般为特定时间内调查群体的患病率，因此通过高血压普查，可计算当地的高血压患病率（C对ABDE错）。